噪声对机体作用受哪些因素影响
A. 噪声强度、接触时间
B. 噪声的频谱、类型、接触方式
C. 机体的健康状况和敏感性
D. 上述A和B两项
E. 上述A、B和C三项都是

正确答案：E。上述A、B和C三项都是

解析：本题考查影响噪声对机体作用的因素。影响噪声对机体的作用因素有很多，包括噪声的强度和频谱特性、接触时间和接触方式、噪声的性质、其他有害因素共同存在、机体健康状况及个人敏感性、个体防护等（E对ABCD错）。